某肺叶发生肺不张时，典型的X线表现是
A. 中等密度，边界不清的云絮状阴影
B. 密度增高，边缘清楚，呈散在小花朵状阴影
C. 密度增高，边缘锐利的线条状阴影
D. 斑点状或小块状，密度甚高的致密阴影
E. 三角形，密度均匀增高的片状阴影

正确答案：E。三角形，密度均匀增高的片状阴影

解析：肺不张系指一个或多个肺段或肺叶的容量或含气量减少。由于肺泡内气体吸收，肺不张通常伴有受累区域的透光度降低，邻近结构向不张区域聚集，有时可见肺泡腔实变，其他肺组织代偿性气肿。不张的肺组织透亮度降低，均匀性密度增高，恢复期或伴有支气管扩张时可密度不均。不同程度的体积缩小，亚段及以下的肺不张可因有其他侧枝的通气而体积缩小不明显。叶段性肺不张一般呈钝三角形，密度均匀增高的片状阴影（E对）。中等密度，边界不清的云絮状阴影（A错）是肺结核的典型的X线表现。密度增高，边缘清楚，呈散在小花朵状阴影（B错）为肺炎的典型X线改变。密度增高，边缘锐利的线条状阴影（C错）为胸腔积液的典型X线改变。斑点状或小块状，密度甚高的致密阴影（D错）为周围型肺癌的典型X线表现。